既可使肩关节屈和旋内又可使肩关节伸和旋外的肌是
A. 胸大肌
B. 三角肌
C. 大圆肌
D. 肱二头肌
E. 背阔肌

正确答案：B。三角肌

解析：胸大肌（A错）使肩关节内收、旋内和前屈。三角肌（B对）主要作用是使肩关节外展，前部肌束可以使肩关节屈和旋内，后部肌束能使肩关节伸和旋外。大圆肌（C错）使肩关节后伸，内收、旋内。肱二头肌（D错）屈肘关节，使前臂旋后；协助屈肩关节。背阔肌（E错）使肩关节后伸、内收及旋内。